腹部外伤伴有内出血休克，最有价值的处理原则是
A. 补充液体
B. 给予镇静剂
C. 使用血管活性物质
D. 控制感染
E. 及时手术探查

正确答案：E。及时手术探查

解析：腹部外伤伴内出血休克提示腹腔内实质性脏器破裂出血或大血管损伤，由于出血量较大、病情进展较快，因此应积极抗休克的同时，及时手术探查（E对），以彻底控制出血，纠正休克。补充体液（A错）可以缓解休克症状；使用血管活性物质（C错）有助于维持患者血压；给予镇静剂（B错）、应用抗生素控制感染（D错）均为一般辅助治疗方法，对于腹部外伤伴有内出血休克的患者，上述处理方法的治疗价值均不及手术探查。